肢体屈伸不利的症状与寒邪的哪种性质和致病特点有关
A. 寒为阴邪，伤人阳气，肢体失于温养
B. 寒性凝滞，气血流行不畅
C. 寒伤肌表，卫阳被遏，肢体失于温养
D. 寒性收引，经脉拘急
E. 寒性黏滞，气机不畅

正确答案：D。寒性收引，经脉拘急

解析：寒性收引指寒邪侵袭人体，可使气机收敛，腠理、经络、筋脉收缩而挛急。寒克经络关节，则经脉收缩拘急，甚则挛急作痛，屈伸不利，或冷厥不仁可知（D对）。寒为阴邪，伤及阳气，肢体失于温煦，并不是导致肢体屈伸不利的原因（A错）。寒性凝滞，易使气血津液凝结、经脉阻滞不通，不通则痛，故疼痛是寒邪致病的重要临床表现。但寒性凝滞并不是导致肢体屈伸不利的原因（B错）。寒邪袭表，卫阳被遏，可见恶寒、无汗、鼻塞、流清涕等症，不是肢体屈伸不利的原因（C错）。寒邪无黏滞的性质（E错）。